醛固酮受体阻断剂螺内酯引起的不良反应是
A. 低钾血症
B. 高钾血症
C. 高镁血症
D. 心律失常
E. 踝足肿胀

正确答案：B。高钾血症

解析：本题考查药物的不良反应。醛固酮受体阻断剂螺内酯引起的不良反应是高钾血症（B对）。螺内酯的不良反应中高钾血症最为常见。长期大量服用本品可引起头痛、困倦与精神紊乱等。此外，还有性激素样副作用，可引起男子乳房女性化和性功能障碍，妇女多毛症、月经失调等。低钾血症（A错）是噻嗪类利尿药的不良反应。踝足肿胀（E错）是钙通道阻滞剂的典型不良反应。